下唇麻木是什么神经注射成功的主要标志
A. 下牙槽神经
B. 上牙槽中神经
C. 上牙槽后神经
D. 鼻腭神经
E. 腭前神经

正确答案：A。下牙槽神经

解析：下牙槽神经阻滞麻醉的麻醉区域及效果：同侧下颌骨、下颌牙、牙周膜、前磨牙至中切牙唇（颊）侧牙龈、黏骨膜及下唇部，以下唇麻木为注射成功的主要标志。掌握“颌面部常用局麻法及牙拔除的麻醉选择”知识点。